怀疑舍格伦综合征时，一般可进行哪一腺体的活体组织病理检查
A. 腮腺
B. 下颌下腺
C. 舌下腺
D. 唇腺
E. 腭腺

正确答案：D。唇腺

解析：本题考查舍格伦综合征的活体组织病理检查。舍格伦综合征是一种自身免疫性疾病，确诊多取唇腺组织活检（D对）。唇腺与大唾液腺的病理变化基本相似。